以下哪项是固定桥最重要的支持基础
A. 牙周膜
B. 牙槽骨
C. 牙龈
D. 结合上皮
E. 黏膜

正确答案：A。牙周膜

解析：本题考查固定桥最重要的支持基础。牙周膜（A对）是固定桥最重要的支持基础。牙周膜是连接牙槽骨和牙之间的结缔组织，通过横行贯通纤维将牙根悬挂固定在牙槽窝内。基牙的牙周潜力主要由基牙的牙周组织和颌骨的健康状况决定，牙周膜起着重要的作用。